患者，男，46岁，慢性乙肝史8年，肝硬化，门脉高压，发生大量呕血，考虑食道胃底静脉曲张破裂出血。首选止血措施为
A. 三腔二囊管压迫
B. 内镜治疗
C. 胃管注入冰水
D. 胃内注射或口服去甲肾上腺素
E. 使用生长抑素

正确答案：E。使用生长抑素

解析：患者有慢性乙肝史，肝硬化，门脉高压，发生大量呕血，考虑食道胃底静脉曲张破裂出血首选止血措施为使用生长抑素。生长激素释放抑制激素是适用于急性胃溃疡出血、糜烂和出血性胃炎所致的出血、严重的急性食道静脉曲张出血、胰胆和胃肠娄及急性胰腺炎的治疗以及胰腺术后并发症的预防的一种药物（E对）。三腔二囊管压迫主要用于门静脉高压引起的食管-胃底静脉曲张破裂出血的急救治疗（A错）。内镜治疗常用于切除肿瘤，吸除分泌物，摘除异物，扩张狭窄，注射药物，切除病变器官、组织等（B错）。胃管注入冰水，加肾上腺素，起到收缩血管，止血的作用（C错）。胃内注射或口服去甲肾上腺素一般用于上消化道出血患者的止血治疗（D错）。